长期、大剂量使用头孢菌素类抗菌药物，可出现低凝血酶原血症增加出血风险应及时补充的维生素是
A. 维生素A
B. 维生素C
C. 维生素D
D. 维生素E
E. 维生素K

正确答案：E。维生素K

解析：本题考查药物的联合应用。长期、大剂量使用头孢菌素类抗菌药物，可出现低凝血酶原血症增加出血风险应及时补充的维生素是维生素K（E对）。部分头孢菌素与维生素K竞争性结合谷氨酸-γ羟化酶，减少维生素K的合成，导致维生素K依赖性凝血因子合成障碍。长期应用（10日以上），宜补充维生素K、复方维生素B。维生素C（B错）用于防治坏血病。维生素D（C错）用于治疗骨质疏松，抵抗性佝偻病。维生素E（D错）临床用于治疗先兆流产和习惯性流产。